男，40岁。不慎右小腿被手榴弹炸伤3小时，包扎后就诊。查体：右小腿后不规则伤口长4cm。肌肉破损渗血，有弹药污染。宜采取的处理方法是
A. 清洗伤口止血加压包扎
B. 消毒探査伤口后包扎
C. 清创引流缝合伤口
D. 清创引流后延期缝合
E. 清创缝合伤

正确答案：D。清创引流后延期缝合

解析：患者右小腿被炸伤，为火器伤。火器伤局部治疗主要是尽早清创，充分显露伤道，清除坏死和失活组织，清创后不宜一期缝合，因为初期清创时，挫伤区和震荡区参差交错，不易判断。此时应保持伤口引流通畅3～5天后，酌情行延期缝合。故患者宜采取的处理方法是清创、引流后延期缝合（D对）。